模型观测时，调整义齿就位道的方向可以
A. 改变基牙倒凹的位置，加大制锁角度
B. 改变基牙倒凹的位置，减小制锁角度
C. 改变基牙倒凹的深度、坡度，加大制锁角度
D. 改变基牙倒凹的深度、坡度，改变制锁角度
E. 改变基牙倒凹的深度、坡度，改变倒凹的位置

正确答案：D。改变基牙倒凹的深度、坡度，改变制锁角度

解析：调整就位道：改变就位道将导致基牙的倒凹深度、坡度以及制锁角的变化，从而达到增减固位力的目的。掌握“局部义齿的设计”知识点。